各级卫生防疫站，对学校卫生工作承担下列任务，但不包括
A. 实施学校、卫生监测，掌握本地区学生生长发有和健康状况，掌握学生常见病、传染病、地方病动态
B. 制定学生常见病、传染病、地方病的防治计划
C. 对本地区学校，卫生工作进行技术指导
D. 开展学校卫生服务
E. 指导学校开展爱国卫生运动

正确答案：E。指导学校开展爱国卫生运动